在疾病的诊治过程中，将医生个人的临床经验与现有最好的临床科学证据相结合，同时考虑患者的价值，最后为每个患者作出最佳诊治决策，属于
A. 实验医学
B. 现代医学
C. 临床医学
D. 基础医学
E. 循证医学

正确答案：E。循证医学

解析：本题考查对循证医学的理解。循证医学是有意识地、明确地、审慎地利用现有最好的证据制定关于个体患者的诊治方案。在疾病的诊治过程中，将医生个人的临床经验与现有最好的临床科学证据相结合，同时考虑患者的价值，最后为每个患者作出最佳诊治决策，属于循证医学（E对ABCD错）。